心尖朝向
A. 左前方
B. 左方
C. 左下方
D. 左前下方
E. 右方

正确答案：D。左前下方

解析：心尖朝向左前下方（D对），由左心室构成。